男，28岁。双下肢进行性无力3天。现无法上楼，尿潴留。有冶游史，2周前感冒。查体：胸4平面以下深浅感觉消失，双下肢肌力2级，腱反射消失，Babinski征阳性。脑脊液细胞数0，蛋白100mg/L，糖和氯化物正常，RPR阴性。MRI示胸4～9脊髓略增粗，T2加权像见条索状高信号。最可能的诊断是
A. 脊髓髓内肿瘤
B. 脊髓血管畸形
C. 压迫性脊髓病（颈椎骨质增生）
D. 急性脊髓炎
E. 脊髓痨

正确答案：D。急性脊髓炎

解析：急性脊髓炎典型表现为发病前1-2周感染或接种史，数小时或数日内受累平面以下出现运动障碍、感觉缺失和尿便潴留等横贯性损害，发病部位以T3-T5最常见。本例患者青壮年男性，双下肢进行性无力3天，尿潴留，2周前感冒，查体：胸4平面以下深浅感觉消失，双下肢肌力2级，腱反射消失，Babinski征阳性（横贯性损害），脑脊液细胞数、蛋白、糖和氯化物均正常，RPR阴性，MRI示胸4-9脊髓略增粗，T2加权像见条索状高信号。诊断为急性脊髓炎（D对）。脊髓髓内肿瘤（A错）会有肿瘤所在脊髓平面的神经根痛表现。脊髓血管畸形（B错）有疼痛症状，无脊髓横贯性损害表现。压迫性脊髓病（颈椎骨质增生）（C错）分为神经根型、交感神经型、椎动脉型、脊髓型等，MRI可发现骨质增生。脊髓痨（E错）会有典型的跟腱压痛觉较弱或消失表现，无脊髓横贯性损害。